后溪的主治病证是
A. 乳痈
B. 气喘
C. 癫狂痫
D. 目视不明
E. 齿痛

正确答案：C。癫狂痫

解析：该题主要考查腧穴的主治功能。后溪属于手太阳小肠经腧穴，位于第五掌指关节尺侧近端赤白肉际凹陷中。后溪主治头项强痛、腰背痛、手指及肘臂挛痛等痛证；耳聋、目赤；癫狂病（C对）；疟疾。